成釉器基底部凹面形态已经确定，开始出现前后牙冠形态的是哪一时期
A. 牙乳头
B. 牙囊
C. 帽状期
D. 蕾状期
E. 钟状期

正确答案：E。钟状期

解析：本题考查成釉器的发育。成釉器基底部凹面形态已经确定，开始出现前后牙冠形态的是钟状期（E对）。在胚胎第11～12周，成釉器长大，上皮凹陷更深其周缘继续生长，形似吊钟，称为钟状期成釉器，此期成釉器进入成熟期，其凹面形状已确定。牙乳头（A错）起源于外胚间充质，形成于帽状期，帽状期时，成釉器下方的球形细胞凝集区称为牙乳头。牙囊（B错）起源于外胚间充质，形成于帽状期，帽状期时，包绕成釉器和牙乳头边缘的外胚间充质细胞密集成结缔组织层形成牙囊。帽状期（C错）为胚胎第9-10周，上皮芽继续向外胚间充质中生长，体积逐渐增大，可形成牙乳头、牙囊、釉结、釉索等结构。蕾状期（D错）在胚胎第8周，牙板上20个定点上的牙板末端膨大，上皮细胞增生突入外胚间充质中，形成上皮芽，形状如花蕾。